时间分布
A. 森林脑炎见于春天
B. 吸毒、不正当性行为可致艾滋病
C. 城市肺癌发病率和死亡率高于农村
D. 流行性乙型脑炎和脊髓灰质炎多有隐性流行
E. 霍乱可发生大流行

正确答案：A。森林脑炎见于春天

解析：本题考查时间分布的特征。疾病频率随着时间的推移呈现出动态变化，通过疾病的时间分布可了解疾病的流行规律，森林脑炎随着时间的变化，呈现出在春天高发的规律（A对BCDE错），属于疾病的时间分布。